翼内肌有深、浅两头，浅头起于
A. 上颌骨颧突及颧弓下缘的前2/3
B. 颞窝及颞深筋膜深面
C. 腭骨锥突及上颌结节
D. 蝶骨大翼的颞下面，颞下嵴及翼外板的外侧面
E. 上颌骨的眶下缘及额突

正确答案：C。腭骨锥突及上颌结节

解析：本题考查咀嚼肌、颈部肌及口颌系统肌链。翼内肌有深、浅两头，深头起于翼外板的内侧面和腭骨锥突；浅头起于腭骨锥突和上颌结节（C对），与咬肌纤维方向相似，止于下颌角内侧面及翼肌粗隆。功能：上提下颌骨。亦参与下颌前伸和侧方运动。